关于膀胱的叙述，不正确的说法是
A. 膀胱黏膜在充盈时比较光滑，而空虚时除膀胱三角区以外，余部则形成许多黏膜皱襞
B. 正常平均容量为350~500ml
C. 输尿管间襞呈苍白色，是寻找输尿管口的标志
D. 膀胱三角处，由于缺少黏膜下层，故在空虚时也不形成皱襞,为结核、肿瘤的好发部位
E. 新生儿膀胱的位置较成人低，完全位于小骨盆腔内

正确答案：E。新生儿膀胱的位置较成人低，完全位于小骨盆腔内

解析：膀胱三角始终保持平滑，是肿瘤、结核和炎症的好发部位，膀胱空虚时其他地方形成许多黏膜皱襞（AD对）。输尿管间襞在膀胱镜下所见为一苍白带，是临床寻找输尿管口的标志（C对）。通常正常成年人的膀胱容量平均为 350 -500ml（B对）。新生儿膀胱的位置高于成年人，空虚时尿道内口在耻骨联合上缘水平，空虚时全部位于盆腔内为成人膀胱的特点（E错，为本题正确答案）。